多尿是指24小时尿量大于
A. 2000mL
B. 1000-2000mL
C. 1500mL
D. 3000mL
E. 2500mL

正确答案：E。2500mL

解析：正常成人24小时尿量约为1000-2000mL（B错），多尿是指24小时尿量大于2500mL（E对）。